导致牙列缺失最常见的原因是
A. 龋病
B. 牙周病
C. 外伤
D. A+B
E. B+C

正确答案：D。A+B

解析：导致牙列缺失最常见的两个病因为龋病和牙周病，此外，全身疾病、外伤、不良修复体，发育异常等。掌握“牙列缺失后的病因及影响”知识点。